性平，能祛风湿、通经络、利小便的中药是
A. 络石藤
B. 臭梧桐
C. 穿山龙
D. 青风藤
E. 香加皮

正确答案：D。青风藤

解析：本题考查青风藤的功效。性平，能祛风湿、通经络、利小便的中药是青风藤（D对）。青风藤【功效】祛风湿，通经络，利小便。络石藤（A错）【功效】祛风通络，凉血消肿。臭梧桐（B错）【功效】祛风湿，通经络，降血压。穿山龙（C错）【功效】祛风除湿，活血通络，化痰止咳。香加皮（E错）【功效】祛风湿，强筋骨，利水消肿。